混溶钙池是指
A. 骨骼钙、血液中的钙
B. 血液中的钙、牙齿中的钙
C. 牙齿中的钙、骨骼钙
D. 毛发中的钙、牙齿中的钙
E. 软组织、细胞外液和血液中的钙

正确答案：E。软组织、细胞外液和血液中的钙

解析：钙是人体含量最多的矿物质元素，占人体体重的1.5%-2.0%。其中约99%的钙集中在骨骼和牙齿中；其余1%分布于软组织、细胞外液和血液中，统称为混溶钙池。